支气管哮喘急性发作患者，提示病情危重的情况是
A. 三凹征
B. 双肺满布哮鸣音
C. 胸部X线片示肺充气过度
D. 呼气峰流速（PEF）显著下降
E. PaCO₂增高

正确答案：E。PaCO₂增高

解析：支气管哮喘急性发作患者病情危重时病人不能讲话，胸腹矛盾运动，严重低氧血症和高二氧化碳血症（E对）。双肺满布哮鸣音（B错）和三凹征（A错）提示患者中重度发作。肺充气过度（C错）和呼气峰流速（PEF）显著下降（D错）为哮喘急性发作的一般特征。